李某怀孕期间到医院进行产前检查，此时医生如果发现一些情况存在，就会提出终止妊娠的医学意见，这些情况中不包括
A. 李某有致畸物质接触史
B. 胎儿有严重缺陷
C. 胎儿患严重遗传性疾病
D. 李某患严重高血压，继续妊娠会危及其生命
E. 李某患严重糖尿病，继续妊娠会严重危害其健康

正确答案：A。李某有致畸物质接触史